以下对糖皮质激素作用的错误叙述为
A. 抗炎作用
B. 免疫抑制作用
C. 抗外毒素作用
D. 抗休克作用
E. 稳定溶酶体膜作用

正确答案：C。抗外毒素作用

解析：本题考查糖皮质激素的作用。对糖皮质激素作用的错误叙述为抗外毒素作用（C错，为本题的正确答案）。糖皮质激素的作用有：1.对代谢的影响；2.抗炎作用（A对）；3.免疫抑制（B对）与抗过敏作用；4.抗休克作用（D对）：常用于严重休克，特别是感染中毒性休克的治疗，大剂量糖皮质激素抗休克作用机制可能是：①抑制某些炎性因子的产生，减轻全身炎症反应综合征及组织损伤，使微循环血流动力学恢复正常，改善休克状态；②稳定溶酶体膜（E对），减少心肌抑制因子（MDF）的形成；③扩张痉挛收缩的血管和兴奋心脏、加强心脏收缩力；④提高机体对细菌内毒素的耐受力；但对外毒素则无防御作用；5.允许作用、退热作用等。